治疗外科跌打损伤瘀血肿痛，应选用的药物是
A. 郁金
B. 乳香
C. 白及
D. 益母草
E. 水蛭

正确答案：B。乳香

解析：乳香辛香走窜，苦泄温通，入心、肝经，既能行气通滞，散瘀止痛，又能活血消痈，祛腐生肌，为外伤科要药。治跌打损伤，常配伍没药、血竭、红花等，如七厘散（B对）。郁金的功效为活血止痛，行气解郁，清心凉血，利胆退黄。治疗气滞血瘀，胸胁刺痛，胸痹心痛，月经不调，经闭痛经，乳房胀痛；热病神昏，癫痫发狂；血热吐衄，妇女倒经；肝胆湿热，黄疸尿赤，胆胀胁痛（A错）。白及的功效为收敛止血，消肿生肌。治疗咳血，吐血，外伤出血；疮疡肿毒，皮肤皲裂，烧烫伤（C错）。益母草的功效为活血调经，利尿消肿，清热解毒。治疗瘀滞月经不调，痛经经闭，恶露不尽；水肿尿少；跌打损伤，疮痈肿毒（D错）。水蛭的功效为破血通经，逐瘀消癥。治疗血瘀经闭，癥瘕痞块；中风偏瘫，跌打损伤，瘀滞心腹疼痛（E错）。